李某因要报考研究生，欲向单位请假复习，遂找到其中学同学、县医院的执业医师王某、请王某为其开具病假条。王某为李开出了“病毒性心肌炎，全休1个月”的诊断证明书。对于王某的行为，县卫生局可以给予
A. 取消处方权
B. 罚款
C. 调离医师岗位
D. 行政处分
E. 责令暂停执业6个月～1年

正确答案：E。责令暂停执业6个月～1年

解析：李某想以生病为理由请假外出旅游，遂请求朋友医师刘某为自己开病假条，刘某为李某开具病毒性心肌炎全休一个月的诊断证明书（未经亲自诊查，签署诊断诊断证明书）。对医师刘某的行为，卫生部门给与的处罚为责令暂停执业6个月～1年（E对）。